24岁，10天前因停经41天，妊娠试验阳性，行吸宫流产术，今晨突然晕倒在地，体温37.5℃，血压10.0/7.0kPa（75/52mmHg），脉搏100次/分，下腹压痛及反跳痛明显，外阴少量流血，宫颈举痛明显，宫口闭，子宫稍大，稍软，右侧似有一包块边缘不清，压痛，查WBC10×109/L，N0.70，最准确的诊断是
A. 流产后右附件炎
B. 人工流产不全
C. 右输卵管妊娠破裂
D. 宫颈粘连
E. 急性阑尾炎

正确答案：C。右输卵管妊娠破裂

解析：下腹压痛及反跳痛明显，外阴少量流血，宫颈举痛明显，宫口闭，子宫稍大，稍软，右侧似有一包块边缘不清，压痛，这些均为输卵管妊娠破裂的典型症状掌握“异位妊娠”知识点。